关于妊高征的防治以下哪项是不正确的
A. 左侧卧位
B. 严格限制盐的摄入
C. 给予降压药
D. 预防低钙
E. 预防和纠正贫血

正确答案：E。预防和纠正贫血